对大多数革兰阳性菌、革兰阴性菌和厌氧菌均有强大抗菌活性的药物是
A. 氨苄西林
B. 头孢唑林
C. 亚胺培南
D. 青霉素
E. 氨曲南

正确答案：C。亚胺培南

解析：本题考查亚胺培南。亚胺培南（C对）属于碳青霉烯类，是抗菌谱最广的β-内酰胺类药物，对革兰阳性菌、革兰阴性菌、需氧菌、厌氧菌均有很强的抗菌活性。氨苄西林（A错）对青霉素敏感的革兰氏阳性菌以及部分革兰氏阴性杆菌有活性。头孢唑林（B错）主要作用于需氧革兰阳性球菌和少数肠杆菌科细菌。青霉素（D错）主要是抗革兰氏阳性菌，对革兰氏阴性杆菌作用较弱。氨曲南（E错）对需氧革兰阴性菌有效，对革兰阳性菌和厌氧菌作用差。